治疗咽喉肿痛肺胃热盛者，应主选的是
A. 中渚、风池
B. 风池、外关
C. 太渊、曲池
D. 列缺、照海
E. 内庭、鱼际

正确答案：E。内庭、鱼际

解析：咽喉肿痛治宜清热利咽、消肿止痛，以局部穴及手太阴、足阳明经穴为主。主穴选用廉泉、天突、尺泽、少商、内庭、关冲。廉泉、天突疏导咽部之气血以治标；尺泽为手太阴经合穴，泻肺经实热，取“实则泻其子”之意；少商系手太阴经井穴，点刺出血，可清泻肺热，为治疗喉证的主穴；内庭能泻阳明之郁热，配以三焦经井穴关冲，点刺出血，加强清泻肺胃热邪之功，起到消肿清咽的作用。肺胃实热配商阳、鱼际，商阳为为手阳明大肠经的井穴，主治齿痛，咽喉肿痛；鱼际清肺泄热，利咽止痛（E对）。